涎石病的形成可能与下列哪项因素无关
A. 钙盐容易沉积
B. 颌下腺导管自下向上走行，导管长
C. 分泌的唾液富含黏蛋白
D. 下颌下腺钙的含量较腮腺低
E. 下颌下腺导管全程较曲折唾液易于淤滞

正确答案：D。下颌下腺钙的含量较腮腺低

解析：涎石多发于下颌下腺，与下列因素有关：①下颌下腺为混合性腺体，分泌的唾液富含黏蛋白，较腮腺分泌液黏滞，钙的含量也高出2倍，钙盐容易沉积。②下颌下腺导管自下向上走行，腺体分泌液逆重力方向流动，导管长，在口底后部有一弯曲部，导管全程较曲折，这些解剖结构均使唾液易于淤滞，导致涎石形成。掌握“涎石病及下颌下腺炎”知识点。